下列疾病中，上皮细胞间失去了连接，属于自身免疫病的疾病是
A. 白塞病
B. 天疱疮
C. 类天疱疮
D. 红斑狼疮
E. 多性形红斑

正确答案：B。天疱疮

解析：本题考查口腔黏膜大疱性疾病。天疱疮（B对）是一种严重的、慢性的粘膜-皮肤自身免疫大疱性疾病。各型天疱疮的基本病理变化为棘细胞层松解或上皮内疱形成，尼氏征阳性。棘细胞层细胞间失去了连接，疱内见有松解的单个棘细胞。白塞病（A错）是一种以细小血管炎为病理基础的慢性进行性复发性系统损害性疾病，无上皮细胞松解现象。类天疱疮（C错）是一种自身免疫性皮肤黏膜病，形成上皮下疱，基底膜不清晰，无棘细胞松解症现象。红斑狼疮（D错）是一种慢性皮肤-黏膜结缔组织疾病，病损特点为持久性红斑中央萎缩凹下呈盘状，皮肤病损表面有粘着性鳞屑，上皮细胞尚有连接。多性形红斑（E错）是由超敏原引起的粘膜皮肤的一种急性渗出性炎症性疾病，有上皮下疱形成，尼氏征阴性，无上皮细胞松解现象。